关于全身疾病对牙周治疗的影响应考虑
A. 糖尿病
B. 心血管疾病
C. 凝血机制异常
D. 传染性疾病
E. 以上都是

正确答案：E。以上都是

解析：本题考查牙周疾病与全身疾病和健康的关系。诊治牙周炎不只是口腔局部问题，应充分了解患者的全身疾病及其治疗史，寻找共同的危险因素，根据患者的全身病情和易感程度制定合理的牙周治疗计划；对一些高危患者（如有风湿性心脏病、糖尿病（A对）、肾病等）在做复杂的牙科检查和治疗前，应预防性应用抗生素，以防暂时性菌血症，手术操作应轻柔以减少创面和创伤等。凝血机制异常（C对）者因高血压、心脑血管疾病（B对）、严重肝病或因其他原因长期服用抗凝剂者，常有出血倾向，牙周洁治、刮治及手术前应检查其出、凝血时间和凝血酶原时间；操作应轻柔，减小创伤；治疗结束时可轻轻压迫牙龈并仔细检查有无残留的肉芽组织及渗血，必要时应观察20分钟，确认局部无活动的出血时，才让患者离去。对待其他可导致异常出血的疾患如血小板减少性紫癜、血友病等血液病，均应与内科医生密切合作，谨慎地施以牙周治疗。传染性疾病（D对）对于活动性传染病，不做常规的牙周治疗，只在严格防交叉感染的条件下，做应急处理。有些患者可能不知道自己患有传染性疾病，或不向医生报道，因此在临床上应按“一致对待”的原则来处理每位患者，以防止医院内感染。因此选E。